梅毒的杨梅疮在感染后出现的时间是
A. 1周左右
B. 3周左右
C. 5周左右
D. 8周左右
E. 10周左右

正确答案：E。10周左右

解析：疳疮消退后，约在感染后7-10周，潜伏的螺旋体大量繁殖，进入血液循环，侵入多种组织内，全身皮肤粘膜广泛出现杨梅疮，成为二期梅毒，书中所言7-10周，然8周时疳疮可能才刚消退，非最佳（E对）。感染梅毒，在不洁性交后约2-4周，常表现为外生殖器部位出现疳疮，为一期梅毒（AB错）。疳疮不经治疗，可在3-8周内自然消失，而淋巴结肿大持续较久，而杨梅疮常在疳疮消退后才出现（CD错）。